医学道德是一种职业道德，它不是
A. 只存在于从事医生职业活动的人们中间
B. 在内容上具有稳定性连续性
C. 在形式上比较具体生动
D. 医务人员容易理解接受
E. 人道主义精神的集中体现

正确答案：A。只存在于从事医生职业活动的人们中间

解析：医学道德现象是医疗卫生领域中存在的且能够被人们感知的具有善恶、正邪、荣辱等评价意义的社会现象的统称。医疗卫生领域中的人际关系至少包括如下方面：1.人与人之间的关系，如：医患关系、医医关系、医护关系；2.人与组织之间的关系，如：医务入员与医疗机构及其科室之间的关系；3.组织之间的关系，如：医联体内部大医院和社区卫生服务中的关系，医疗机构与卫生主管部门的关系。4.人、医疗机构与社会之间的关系；5.人与自然环境之间的关系（A错，为本题正确答案）。